关于统计表横标目的叙述，错误的说法是
A. 横标目又称主辞
B. 通常置于表的左侧
C. 研究事物的指标
D. 按其发生频率的大小顺序来排列
E. 研究事物的对象

正确答案：C。研究事物的指标

解析：统计表的标目：有横标目和纵标目，横标目又称主辞，是研究事物的对象，通常置于表的左侧，一般按其发生频率的大小顺序来排列，使其重点突出和对比鲜明，或按事物的自然顺序排列。纵标目是研究事物的指标，又称宾辞，列在表的上方，其表达结果与主辞呼应。当主辞的标志不止一个时，可将部分主辞与宾辞复合。标目的正确安排可使读者自左向右顺利阅读。掌握“统计表和统计图”知识点。